睫状体肌收缩时变松弛的是
A. 虹膜
B. 睫状体
C. 睫状小带
D. 晶状体
E. 脉络膜

正确答案：C。睫状小带

解析：睫状小带（C对）连结睫状体和晶状体，且睫状体肌纤维呈环形分布，当睫状体肌收缩时，睫状小带松弛，晶状体凸度变大。